10个月女婴，单纯母乳喂养，面色渐苍白2个月烦躁食欲不佳，不愿活动，肝肋下2cm，Hb70g/L，RBC3.6×10¹²/L，MCV70fl，MCH23pg，MCHC29%，最可能的诊断是
A. 营养性巨幼细胞贫血
B. 营养性缺铁性贫血
C. 再生障碍性贫血
D. 地中海贫血
E. 铁幼粒红细胞贫血

正确答案：B。营养性缺铁性贫血

解析：10个月女婴（缺铁性贫血多见年龄），单纯母乳喂养（缺铁性贫血病因），面色渐苍白2个月烦躁食欲不佳，不愿活动（缺铁性贫血一般表现），肝、肋下2cm（髓外造血表现），Hb70g/L（正常值大于110g/L），RBC3.6×10¹²/L（正常值4×10¹²/L）（贫血表现），MCV70fl，MCH23pg，MCHC29%（小细胞低色素性贫血），根据患儿的病史、临床表现、查体结果和实验室检查，最可能的诊断是营养性缺铁性贫血（B对）。而营养性巨幼红细胞贫血（P359）（A错）主要是由于维生素B12和（或）叶酸缺乏所致的一种大细胞性贫血，其临床突出表现为患儿有神经精神症状，如烦躁不安、易怒、表情呆滞、目光发直等，外周血象结果呈大细胞性贫血，MCV＞94fl，MCH＞32pg。再生障碍性贫血（C错）表现为发热、贫血和出血，肝、脾、淋巴结不肿大，血象呈全血细胞减少，骨髓有核细胞增生低下，无幼稚白细胞增生，故该患儿不考虑此病。地中海贫血（D错）的患儿多有阳性家族史，其血象呈小细胞低色素性贫血，红细胞大小不等，中央浅染区扩大，出现异形、靶形、碎片红细胞和有核红细胞等，网织红正常或增高。铁幼粒红细胞贫血（E错）指由于血红色合成障碍及铁利用不良而导致的贫血，其血象为骨髓幼红细胞增生，伴大量环形铁粒细胞出现和无效红细胞生成，组织贮存铁及血清铁增高的低色素性贫血。